菌斑生物膜的独特结构有利于细菌
A. 被清除
B. 抵抗宿主防御功能
C. 与表面活性剂接触
D. 被抗生素杀灭
E. 接近抗体

正确答案：B。抵抗宿主防御功能

解析：牙菌斑生物膜的结构可给菌斑生物膜内不同细菌输送营养物质、清除代谢废物，使细菌发挥各自的致病作用，是不同细菌共同获益的途径。菌斑生物膜具较强的抵抗力，高黏度的基质具有屏障作用，可耐受干燥。抵抗宿主防御成分或药物渗入，使菌斑对抗菌药物的敏感性降低，还可抵抗流水冲刷。掌握“牙周炎病因学”知识点。